下列关于精囊腺的描述何者正确
A. 位于每侧输精管壶腹之内侧
B. 靠在膀胱底之上方
C. 前邻前列腺
D. 经直肠前壁可触及
E. 左右各一，表面光滑

正确答案：D。经直肠前壁可触及

解析：精囊腺位于输精管壶腹的下外侧（A错）。位于膀胱底的后方（B错）。左右各一，表面凹凸不平（E错）。可经直肠前壁触及（D对）。